治疗氨基甲酸酯类农药中毒的首选药是
A. 氯磷定
B. 解磷定
C. 双复磷
D. 阿托品
E. 亚硝酸钠

正确答案：D。阿托品